治疗癫痫持续状态首选
A. 地西泮
B. 哌替啶
C. 氯丙嗪
D. 普鲁卡因
E. 对乙酰氨基酚

正确答案：A。地西泮

解析：​地西泮为长效苯二氮卓类药物，主要通过增强突触前抑制，抑制皮质背侧丘脑和边缘系统的质间造引起的间性放电，扩散而发挥抗癫痫作用（A对）；哌替啶是临床上常用的一种人工合成镇痛药，主要有镇痛、镇静和抑制呼吸等作用（B错）；氯丙嗪是一种吩噻嗪类抗精神病药，有安定、镇静、抗精神病等作用（C错）；普鲁卡因为酯类局麻药，有镇静和镇痛作用，对心肌有负性肌力作用，抑制心肌传导系统，故低浓度时有抗心律失常作用及舒张血管和支气管平滑肌作用（D错）；对乙酰氨基酚是非那西丁的体内代谢产物，有解热、镇痛的作用（E错）。